幽门梗阻患者，下列术前准备最重要的是
A. 纠正碱中毒
B. 低渗盐水洗胃
C. 生理盐水洗胃
D. 口服抗菌药物
E. 高渗盐水洗胃

正确答案：E。高渗盐水洗胃

解析：术前准备包括持续胃管减压和高渗盐水洗胃（E对BC错），以清除胃内潴留的食物，减轻胃粘膜水肿，利于术后愈合。纠正碱中毒（A错）必要时可作为术前准备，但并非首选。幽门梗阻非细菌感染性疾病，不需要口服抗菌药物（D错）。